高热，焮热，是指
A. 风肿
B. 寒肿
C. 热肿
D. 湿肿
E. 痰肿

正确答案：C。热肿

解析：高热、焮热符合热肿的特点（C对），多见于阳证疮疡。风肿的特点是发病急骤，漫肿宣浮，或游走无定，不红微热，或轻微疼痛（A错）。寒肿的特点是肿而不硬，皮色不泽，苍白或紫暗，皮肤清冷，常伴有酸痛，得暖则舒（B错）。湿肿的特点是皮肉重垂胀急，深按凹陷，如烂棉不起，浅则光亮如水疱，破流黄水，浸淫皮肤（D错）。痰肿的特点是肿势软如棉，或硬如馒，大小不一，形态各异，无处不生，不红不热，皮色不变（E错）。